男性，8岁，枕部着地，昏迷5分钟后清醒，并自己回到家中，其后出现头痛并呈逐渐加重伴呕吐，1小时后不省人事，急送医院。查体：130/90mmHg，65次/分，15次/分，浅昏迷，右枕部头皮挫伤，左侧瞳孔4mm，对光反应消失；右侧瞳孔2.5mm，对光反应存在。最可能的诊断是
A. 脑梗塞
B. 蛛网膜下腔出血
C. 颅内血肿
D. 脑挫伤
E. 颅脑肿瘤

正确答案：C。颅内血肿

解析：青年男性患者，枕部外伤，昏迷5分钟后清醒，1小时后又陷入昏迷（昏迷→清醒→昏迷，为急性硬膜外血肿的典型表现）。左侧瞳孔4mm，对光反应消失；右侧瞳孔2.5mm，对光反应存在（双侧瞳孔不等大，左侧对光反射消失，提示左侧动眼神经受压）。综合患者的病史及体查，最可能的诊断是急性硬膜外血肿并小脑幕切迹疝。颅内血肿（C对）包括硬脑膜外血肿、硬脑膜下血肿和脑内血肿。脑梗塞（A错）即脑梗死，又称缺血性脑卒中，指因脑部血液供应障碍，缺血、缺氧所导致的局限性脑组织的缺血性坏死或软化，临床表现以猝然昏倒、不省人事、半身不遂、言语障碍、智力障碍为主要特征。蛛网膜下腔出血（B错）主要见于颅内动脉瘤破裂、畸形脑血管破裂，以偏瘫、视力视野障碍为主要临床表现。脑挫伤（D错）常表现为伤后立即发生的意识障碍，无中间清醒期。颅脑肿瘤（E错）以颅内压增高和神经功能定位症状为主要表现，无外伤史。